腭前神经阻滞麻醉时进针的标志是
A. 上颌第一磨牙腭侧龈缘至腭中线弓形凹面连线的中点
B. 上颌第二磨牙腭侧龈缘至对侧龈缘弓形凹面连线的中点
C. 上颌第三磨牙腭侧龈缘至腭中线弓形凹面连线的中点
D. 上颌第三磨牙腭侧龈缘至对侧龈缘连线的中点
E. 上颌第三磨牙腭侧龈缘至腭中线连线的中点

正确答案：C。上颌第三磨牙腭侧龈缘至腭中线弓形凹面连线的中点

解析：腭大孔的表面标志：腭大孔位于上颌第三磨牙腭侧龈缘至腭中线弓形凹面连线的中点，覆盖其上的黏膜可见小凹陷，即为进针的标志。如第三磨牙尚未萌出则应在第二磨牙腭侧。掌握“颌面部常用局麻法及牙拔除的麻醉选择”知识点。